正确描述颈动脉小球的是
A. 在颈总动脉壁内
B. 在颈内动脉起始处壁内
C. 在颈总动脉分叉处后方
D. 属压力感受器
E. 无上述情况

正确答案：C。在颈总动脉分叉处后方

解析：在颈总动脉分叉处后方（C对）有颈动脉小球，是一个扁椭圆形小体，为化学（D错）感受器。